口底蜂窝织炎主要危险是
A. 引起骨髓炎
B. 呼吸道梗阻
C. 全身中毒反应
D. 高热
E. B+C

正确答案：E。B+C

解析：本题考查口底蜂窝织炎的主要危险。口底蜂窝织炎主要危险是呼吸道梗阻（B对）+全身中毒反应（C对）（BC均对，故E为本题的正确答案）。引起骨髓炎的病因较多，常见为牙源性感染引起的化脓性颌骨骨髓炎（A错）。口底蜂窝织炎又称为口底多间隙感染，是颌面部最严重而治疗最困难的感染之一。化脓性口底蜂窝织炎可引起弥散性肿胀，自发性疼痛和压痛等；腐败坏死性口底蜂窝织炎发病急快，为软组织的广泛副性水肿，可上至面颊部，下至纵隔引起纵隔炎或纵隔脓肿常伴高热（D错）、咽喉痛、张口受限、胸痛，舌体抬高，语言不清，吞咽困难，严重者呼吸道梗阻，甚至出现“三凹”征，引起窒息危险，全身中毒反应明显，血压下降，出现中毒性休克的危险。